在醋酸可的松注射液中作为助悬剂的是
A. 硫柳汞
B. 氯化钠
C. 羧甲基纤维素钠
D. 聚山梨酯80
E. 注射用水

正确答案：C。羧甲基纤维素钠

解析：本题考查注射剂常用的附加剂。醋酸可的松注射液处方分析：醋酸可的松微晶-主药；硫柳汞（A错）-抑菌剂；氯化钠（B错）-渗透压调节剂；聚山梨酯80（D错）-润湿剂；羧甲基纤维素钠（C对）-助悬剂；注射用水（E错）-溶剂。